初产妇，34岁，产后8小时，小便不通，小腹胀急疼痛，坐卧不宁，腰膝酸软，面色晦暗，舌淡，苔薄润，脉沉细无力，尺脉弱。治宜选用
A. 济生肾气丸
B. 木通散
C. 补气通脬饮
D. 黄芪当归散
E. 肾气丸

正确答案：A。济生肾气丸

解析：患者产后小便不通，小腹胀急疼痛，坐卧不宁；腰膝酸软，面色晦暗；舌淡，苔薄润，脉沉细无力，尺脉弱。是由于素体禀赋不足，复因产时损伤肾气，命门火衰，膀胱失其温煦，气化不利，故小便不通。属肾阳亏虚证，选方济生肾气丸（A对）。气滞证用木通散（B错）。肺脾气虚证用补气通脬饮（C错）。产后小便频数与失禁肺脾气虚证用黄芪当归散（D错）。月经病温补肾阳用肾气丸（E错）。